团螵蛸的原动物是
A. 大刀螂
B. 小刀螂
C. 薄翅螳
D. 绿污斑螳
E. 巨斧螳螂

正确答案：A。大刀螂